女，65岁。常规体检发现脾左肋下5cm，化验：Hbl35g/L，WBC117×10⁹/L分类中幼粒5%，晚幼粒12%，杆状核22%，分叶中性粒34%，嗜酸粒5%，嗜碱粒14%，淋巴细胞14%。Plt560×10⁹/L，NAP（-）。进一步应采取的检查是
A. 骨髓干细胞培养
B. 染色体核型
C. 食管造影
D. 间位素扫描
E. 骨髓活检

正确答案：B。染色体核型

解析：患者老年女性，脾左肋下5cm（脾肿大为慢性粒细胞白血病最显著的体征），化验：Hb135g/L（成年女性Hb正常110～150g/L）正常，WBC117×10⁹/L（正常4～10×10⁹/L）（慢性粒细胞白血病白细胞常明显增多，可达100×10⁹/L）。分类中幼粒5%，晚幼粒12%，杆状核22%（正常0%～5%），分叶中性粒34%（正常50%～70%），嗜酸粒5%（正常0.5%～5%），嗜碱粒14%（正常0%～1%），淋巴细胞14%（正常20%～40%）（分类可见各阶段粒细胞，嗜酸性、嗜碱性粒细胞增多，符合慢粒特点），Plt560×10⁹/L（正常100～300×10⁹/L）增多，NAP（-）（急、慢性粒细胞白血病时中性粒细胞成熟障碍，中性粒细胞碱性磷酸酶阴性），故患者诊断为慢性粒细胞白血病的可能性大，给予骨髓检查可以明确诊断，进一步应采取的检查是染色体核型（B对），95%以上的CML细胞中出现Ph染色体（小的22号染色体），显带分析为t（9；22）（q34；q11）（P587），且凡有不明原因的持续性白细胞数增高，根据典型的血象、骨髓象改变，脾大，Ph染色体阳性或BCR-ABL融合基因阳性即可作出诊断（P578）。骨髓干细胞培养（A错）、骨髓活检（E错）操作复杂，目前多用于科研，临床少用；食管造影（C错）、同位素扫描（D错）一般不用于血液病的诊断。